属于开环嘌呤核苷类似物的核苷类抗病毒药是
A. 氟尿嘧啶
B. 金刚乙胺
C. 阿昔洛韦
D. 奥司他韦
E. 拉米夫定

正确答案：C。阿昔洛韦

解析：本题考查开环核苷类抗病毒药。开环嘌呤核苷类似物的抗病毒药包括阿昔洛韦（C对）、更昔洛韦等。氟尿嘧啶（A错）为常见的抗代谢物；金刚乙胺（B错）、奥司他韦（D错）为非核苷类抗病毒药物；拉米夫定（E错）是双脱氧硫代胞苷化合物，具有抗病毒的作用。